判断近2～3个月血糖控制程度的指标是
A. 血浆胰岛素测定
B. 葡萄糖耐量试验
C. 糖化血红蛋白
D. 尿糖
E. 空腹血糖

正确答案：C。糖化血红蛋白

解析：糖化血红蛋白能较稳定的反映采血前2～3内平均血糖水平，可作为糖尿病的诊断依据之一（C对）。血浆胰岛素测定主要用于了解细胞功能，协助判断糖尿病分型和指导治疗，也可以协助诊断胰岛素瘤，但不能作为糖尿病的诊断依据（A错）。葡萄糖耐量试验是血糖高于正常范围而又未达到糖尿病诊断标准的患者需要进行的实验室检查（B错）。尿糖是诊断糖尿病的重要线索，但不能作为糖尿病的诊断依据（D错）。空腹血糖同样也是诊断糖尿病的重要线索，但不能作为糖尿病的诊断依据（E错）。